成人脊髓下端平
A. 第1腰椎下缘水平
B. 第2腰椎下缘水平
C. 第3腰椎下缘水平
D. 第1骶椎下缘水平
E. 第2骶椎下缘水平

正确答案：A。第1腰椎下缘水平

解析：成人脊髓下端平对第1腰椎下缘水平（A对），新生儿可达第3腰椎下缘（C错）。